能反射无线电波，对于无线电通信有重要意义的是
A. 对流层
B. 平流层
C. 中间层
D. 热成层
E. 逸散层

正确答案：D。热成层

解析：本题考查大气层。热成层（D对ABCE错）位于85～800km的高度之间。该层的气体在宇宙射线作用下处于电离状态。电离后的氧能强烈吸收太阳的短波辐射，使空气迅速升温，因而该层的气温随高度的增加而增加。该层能反射无线电波，对于无线电通讯有重要意义。